某男，32岁。因痰火扰心导致癫狂惊悸，喘咳痰稠，大便秘结。治当逐痰降火，宜选用的成药是
A. 蛤蚧定喘丸
B. 通宣理肺丸
C. 二母宁嗽丸
D. 人参保肺丸
E. 礞石滚痰丸

正确答案：E。礞石滚痰丸

解析：本题考查的是礞石滚痰丸的功能。因痰火扰心导致癫狂惊悸，喘咳痰稠，大便秘结。治当逐痰降火，宜选用的成药是礞石滚痰丸（E对）。礞石滚痰丸：【功能】逐痰降火。蛤蚧定喘丸（A错）：【功能】滋阴清肺，止咳平喘。通宣理肺丸（B错）：【功能】解表散寒，宣肺止咳。二母宁嗽丸（C错）：【功能】清肺润燥，化痰止咳。人参保肺丸（D错）：【功能】益气补肺，止嗽定喘。